正常情况下胰液进入十二指肠首先被激活的是
A. 胰蛋白酶原
B. 糜蛋白酶原
C. 激肽释放酶原
D. 前磷脂酶
E. 肠激酶原

正确答案：A。胰蛋白酶原

解析：胰液进入十二指肠，首先胰蛋白酶原（A对）被肠激酶激活为胰蛋白酶。糜蛋白酶原在胰蛋白酶的作用下转化为糜蛋白酶。胰液中的其他酶如羧基肽酶、核糖核酸酶、脱氧核糖核酸酶也以酶原的形式分泌，在糜蛋白酶的作用下被激活。只有胰蛋白酶原在肠激酶的作用下转换为胰蛋白酶，胰液中的其他酶原才能转化为活性形式发挥作用。